以下关于量效关系叙述错误的是
A. LD₅₀与ED₅₀的比值称治疗指数
B. LD₅₀称半数有效量
C. 在一定范围内剂量增加效应增强
D. 量效关系是指药物剂量与效应间的关系
E. 引起最大效应而不出现中毒的剂量称极量

正确答案：B。LD₅₀称半数有效量

解析：治疗指数是LD₅₀/ED₅₀的比值（A对），其中ED₅₀代表半数有效量，即能引起50%实验动物出现阳性反应时的药物的量，如效应为死亡，则成为半数致死量，用LD₅₀表示（B错，为本题正确答案）。药理效应与剂量在一定范围内成正比，这就是量效关系（D对）。在一定范围内，随剂量或浓度的增加，效应也增加（C对），但效应增加到一定程度后，若继续增加药物浓度或剂量而其效应不再继续增加，这一药理效应的极限称为效能。引起最大效应而不出现中毒的剂量称极量（E对）。